脊髓的被摸由外向内依次为
A. 硬脊膜、蛛网膜、软脊膜
B. 硬脊膜、软脊膜、蛛网膜
C. 软脊膜、蛛网膜、硬脊膜
D. 蛛网膜、软脊膜、硬脊膜
E. 软脊膜、硬脊膜、蛛网膜

正确答案：A。硬脊膜、蛛网膜、软脊膜

解析：脊髓的被摸由外向内依次为硬脊膜、脊髓蛛网膜和软脊膜（A对）。